面神经出颅经
A. 圆孔
B. 卵圆孔
C. 棘孔
D. 茎乳孔
E. 面神经管

正确答案：D。茎乳孔

解析：面神经穿内耳道入面神经管，经茎乳孔出颅。向前穿过腮腺，呈扇形分布于面部表情肌。以茎乳孔为界，可将面神经分为面神经管段和颅外段。掌握“面神经、舌咽神经、舌下神经的分支与分布”知识点。